引起人类疾病和死亡的行为相关危险因素种类很多，下列哪项除外
A. 环境危险因素
B. 心理、行为危险因素
C. 生物遗传危险因素
D. 医疗卫生服务中的危险因素
E. 以上都是

正确答案：E。以上都是